患儿，6岁，浮肿4天，小便量少色赤，烦热口渴，头身困重，尿蛋白+，红细胞20个/HP，舌质红，苔黄腻，脉滑数，其首选方剂是
A. 温胆汤
B. 麻黄连翘赤小豆汤
C. 五苓散
D. 龙胆泻胆汤
E. 五味消毒饮

正确答案：E。五味消毒饮

解析：三焦气化失常，则水泛故见浮肿，小便量少色赤；邪热犯内故见烦热口渴；湿浊内盛故见头身困重；湿热内侵故见舌质红，苔黄腻，脉滑数。尿蛋白+，红细胞20个/HP（患者出现血尿、蛋白尿可诊断为急性肾小球肾炎）（E对）。水毒内闭证候：全身水肿，尿少或尿闭，色如浓茶，头晕头痛，恶心呕吐，畏寒肢冷，神疲乏力，嗜睡，甚则昏迷，血尿素氮、肌酐显著升高，舌质淡胖、苔垢腻，脉滑数或沉细数。治法：通腑泄浊，解毒利尿。方药：温胆汤合附子泻心汤加减（A错）。风水相搏证候：起病急，水肿自眼睑开始迅速波及全身，以头面部肿势为著，皮色发亮，按之凹陷随手而起，尿少色赤，恶风寒或发热汗出，咽红咽痛，骨节酸痛，鼻塞流涕，咳嗽，舌质淡，苔薄白或薄黄，脉浮。治法：疏风宣肺，利水消肿。方药：麻黄连翘赤小豆汤合五苓散加减（BC错）。邪陷心肝证候：头痛眩晕，视物模糊，烦躁不安，口苦，恶心呕吐，甚至惊厥，抽搐，昏迷，肢体面部水肿，尿短赤，舌质红，苔黄糙，脉弦数。治法：平肝泻火，清心利水。方药：龙胆泻肝汤合羚角钩藤汤加减（D错）。